成熟的卵泡能分泌大量的
A. 卵泡刺激素
B. 黄体生成素
C. 绒毛膜促性腺激素
D. 雌激素
E. 孕激素

正确答案：D。雌激素